我国慢性肾功能衰竭病因中哪种占首位
A. 高血压肾小动脉硬化
B. 慢性肾盂肾炎
C. 小管间质性肾病
D. 继发性肾小球疾病
E. 原发性肾小球肾炎

正确答案：E。原发性肾小球肾炎

解析：在我国最常见引起慢性肾衰竭的病因按顺序为原发性慢性肾小球肾炎、糖尿病肾病和高血压肾小球动脉硬化。掌握“急性肾孟肾炎、尿路结石及慢性肾衰竭”知识点。